当今影响人类健康的四大因素顺序依次为
A. 行为生活方式、环境因素、生物遗传、医疗卫生保健
B. 环境因素、行为生活方式、生物遗传、医疗卫生保健
C. 行为生活方式、生物遗传、环境因素、医疗卫生保健
D. 行为生活方式、生物遗传、医疗卫生保健、环境因素
E. 行为生活方式、医疗卫生保健、生物遗传、环境因素

正确答案：A。行为生活方式、环境因素、生物遗传、医疗卫生保健

解析：本题考查影响人类健康的四大因素顺序。影响人类健康的四大因素顺序依次为：1.行为生活方式：个体的生活方式和行为习惯对健康有重要的作用。良好的习惯和行为促进健康，不良习惯和嗜好危害健康；2.环境因素：由于人类对自然环境的过度改造，不仅严重地破坏了人们赖以生存的生态系统，而且导致了大量人为的危险因素进入人们的生存环境，各种环境健康危险因素对人类的整体生存带来极其严重的影响；3.生物遗传：生物遗传因素是理解生命活动和疾病损伤及康复过程的基础。随着医学的发展及对疾病认识的不断深入，人们发现无论是传染病还是慢性病的发生都与遗传因素和环境因素的共同作用密切相关；4.医疗卫生保健：医疗卫生服务是防治疾病、增进健康的有效手段，服务的好坏直接影响人群的健康水平（A对BCDE错）。